皮质核束
A. 起于中央前回上部的巨型锥体细胞
B. 通过内囊后脚
C. 面神经核的下半部和舌下神经核只接受对侧皮质核束支配
D. 损伤时出现弛缓性瘫痪（软瘫）
E. 无

正确答案：C。面神经核的下半部和舌下神经核只接受对侧皮质核束支配

解析：皮质核束主要由中央前回下部的锥体细胞（A错）的轴突集合而成，下行经内囊膝（B错）至大脑脚底中 3/5 的内侧部，由此向下陆续分出纤维，终止于双侧脑神经运动核。小部分纤维交叉到对侧，终止于面神经核支配面下部肌的神经元细胞群和舌下神经核，二者发出的纤维分别支配同侧面下部的面肌和舌肌 。 因此，除面神经核下部和舌下神经核只接受单侧（对侧）皮质核束支配（C对）外，其他脑神经运动核均接受双侧皮质核束的纤维，皮质核束损伤，根据具体位置不同，可表现为上运动神经元受损和下运动神经元受损（D错）。